产后出血最常见的病因是
A. 多胎
B. 羊水过多
C. 妊娠高血压疾病
D. 宫缩乏力
E. 巨大胎儿

正确答案：D。宫缩乏力

解析：产后出血最主要的原因是子宫收缩乏力（D对）。多胎（A错）、羊水过多（B错）、巨大胎儿（E错）是影响子宫收缩和缩复功能的子宫因素，而妊娠高血压疾病（C错）是影响子宫收缩和缩复功能的全身因素。